治疗地高辛中毒引起的快速性心律失常的药物是
A. 地高辛抗体
B. 考来烯胺
C. 氢氯噻嗪
D. 阿托品
E. 苯妥英钠

正确答案：E。苯妥英钠

解析：本题考查抗癫痫药。治疗地高辛中毒引起的快速性心律失常的药物是苯妥英钠（E对）。对强心苷中毒引起的重症快速型心律失常，常用苯妥英钠救治。该药能使强心苷从Na⁺，K⁺-ATP酶复合物中解离，恢复酶的活性。它对频发的室性期前收缩、室性心动过速等有明显疗效，并且不减慢房室传导。地高辛抗体（A错）用于危及生命的严重强心苷中毒。考来烯胺（B错）与洋地黄毒苷结合治疗洋地黄中毒。氢氯噻嗪（C错）为噻嗪类利尿药，常用于高血压的治疗。阿托品（D错）用于治疗强心苷中毒时的心动过缓或房室阻滞等缓慢型心律失常。